在一昼夜中，体温最低的时间是
A. 清晨2～6时
B. 早晨7～9时
C. 午后1～5时
D. 傍晚6～7时
E. 睡前9～10时

正确答案：A。清晨2～6时

解析：在一昼夜中，体温最低的时间是清晨2～6时（A对），夜间熟睡时迷走神经兴奋性最高，机体处于超低代谢状态。体温最高的时间是午后1～6时。